静脉注射时，能反映药物在体内消除快慢的是
A. 零阶矩
B. 平均稳态血药浓度
C. 一阶矩
D. 平均吸收时间
E. 平均滞留时间

正确答案：E。平均滞留时间

解析：本题考查药动学参数。静脉注射时，能反映药物在体内消除快慢的是平均滞留时间（E对）；血药浓度-时间曲线下面积（时间从零到无限大）定义为药-时曲线的零阶矩（A错）；平均稳态血药浓度（B错）为重复给药达稳态后，在一个给药间隔时间内，血药-时曲线下面积除以给药间隔时间τ的商值；药-时曲线的一阶矩（C错）为时间与血药浓度的乘积-时间曲线下的面积（AUMC）；在药物进入体循环之前的所有时间称为平均吸收时间（MAT）（D错）。